为了尽量发现病人，在制订诊断标准时，常常
A. 提高灵敏度
B. 提高特异度
C. 降低假阳性率
D. 提高假阴性率
E. 采用串联试验

正确答案：A。提高灵敏度